目前，我国共有多少种法定传染病
A. 甲、乙、丙三类32种
B. 甲、乙、丙三类35种
C. 甲、乙、丙三类36种
D. 甲、乙、丙三类37种
E. 甲、乙、丙三类40种

正确答案：E。甲、乙、丙三类40种

解析：传染病（Infectious Diseases）是由各种病原体引起的能在人与人、动物与动物或人与动物之间相互传播的一类疾病。病原体中大部分是微生物，小部分为寄生虫，寄生虫引起者又称寄生虫病。有些传染病，防疫部门必须及时掌握其发病情况，及时采取对策，因此发现后应按规定时间及时向当地防疫部门报告，称为法定传染病。中国目前的法定传染病有甲、乙、丙3类，共40种。